釉质脱矿常在其表面下方开始，有时可能在看似完整的釉质下方形成龋洞，临床检查常漏诊的龋病是
A. 平滑面龋
B. 窝沟龋
C. 线性釉质龋
D. 根面龋
E. 隐匿性龋

正确答案：E。隐匿性龋

解析：隐匿性龋的釉质脱矿常在其表面下方开始，有时可能在看似完整的釉质下方形成龋洞，因其均有隐匿性，则临床检查常漏诊。掌握“龋病的临床表现与分类”知识点。